不属于人格的投射类测验的是
A. 洛夏墨迹试验
B. 主题统觉试验
C. 霍兹曼墨迹试验
D. 词语联想测验
E. 范畴试验

正确答案：E。范畴试验

解析：投射法多用于测量人格，如洛夏测验（A对）、主题统觉测验（TAT）（B对）等，也有用于异常思维的检测，如自由联想测验、填词测验（D对）等。范畴测验是神经心理测验，要求被试通过尝试、错误，发现一系列图片（156张）中隐含的数字规律，并在反应仪上作出应答，测查被试分析、概括、推理等能力（E错，为本题正确答案）。